中医学的基本特点，主要是
A. 阴阳五行与脏象经络
B. 整体观念与辨证论治
C. 以五脏为主的整体观
D. 望闻问切与辨证论治
E. 辨证求因与审因论治

正确答案：B。整体观念与辨证论治

解析：本题考查中医学的基本特点，属于理解记忆内容。中医学理论体系的主要特点，一是整体观念，二是辨证论治（B对）。